铸造全冠预备时，轴壁正常聚合角及颈部肩台要求
A. 0°无肩台
B. 2°～5°，0.5～0.8mm
C. 2°～5°，0.8～1.5mm
D. 6°～10°，0.8～1.5mm
E. 6°～10°，1.5～2.0mm

正确答案：B。2°～5°，0.5～0.8mm

解析：铸造全冠预备时轴壁正常聚合度一般为2°～5°，铸造全冠颈部肩台通常为0.5～0.8mm宽，呈浅凹形或圆角肩台形。边缘应连续一致，平整，无锐边。为保证肩台预备的质量，可在排龈后再修整，视野清楚，避免损伤牙龈组织。掌握“铸造金属全冠”知识点。